外劳宫位于
A. 手背部，第二、三掌骨间，指掌关节后0.5寸
B. 手背部，第二、三掌骨间，指掌关节后1寸
C. 手背部，第三、四掌骨间，指掌关节后O.5寸
D. 手背部，第二、三掌骨间，指掌关节后2寸
E. 手背部，第三、四掌骨间，指掌关节后l寸

正确答案：A。手背部，第二、三掌骨间，指掌关节后0.5寸

解析：外劳宫定位在左手背侧，当第2、第3掌骨间，指掌关节后0.5寸处（A对）。